属于望舌色的内容是
A. 舌红绛或淡白
B. 萎软还是强硬
C. 苍老还是娇嫩
D. 腻腐还是润燥
E. 胖大还是痩薄

正确答案：A。舌红绛或淡白

解析：望舌色，即望舌质的颜色，多分为淡红舌、淡白舌、红舌、绛舌、青紫舌五种（A对）。萎软还是强硬（B错）属于望舌态的内容，包括萎软、强硬、歪斜、颤动、吐弄等。苍老还是娇嫩（C错）属于望舌形的内容，包括老嫩、胖瘦、点刺、裂纹、齿痕等方面的特征。腻腐还是润燥（D错）属于望苔质的内容，包括厚薄、润燥、腻腐、剥脱、偏全、真假等方面。胖大还是痩薄（E错）属于望舌形的内容，包括老嫩、胖瘦、点刺、裂纹、齿痕等方面的特征。